持久性有机污染物的特征
A. 持久性、迁移性、高毒性、脂溶性
B. 持久性、高毒性、脂溶性、蓄积性
C. 持久性、蓄积性、迁移性、高毒性
D. 迁移性、脂溶性、蓄积性、高毒性
E. 高毒性、易扩散性、持久性、蓄积性

正确答案：C。持久性、蓄积性、迁移性、高毒性

解析：本题考查持久性有机污染物的特征。持久性有机污染物是指能持久存在环境中，并可借助大气，水，生物体等环境介质进行远距离迁移，通过食物链富集，对环境和人类健康造成严重危害的天然或人工合成的有机污染物质。具有以下4个重要特征：持久性、蓄积性、迁移性、高毒性（C对ABDE错）。